儿童期出现的甲状腺结节恶性率为
A. 10%
B. 30%
C. 50%
D. 70%
E. 80%

正确答案：C。50%

解析：儿童时期出现的甲状腺结节有50%（C对）是恶性的（5版外科学P343）。